《外科正宗》的作者是
A. 高锦庭
B. 龚庆宣
C. 陈实功
D. 王怀隐
E. 葛洪

正确答案：C。陈实功

解析：明代陈实功的著作《外科正宗》以“列症最详，论治最精”见称，在外科发展史中成就最大（C对）。清代高秉钧，字锦庭，著有《疡科心得集》（A错）。晋代刘涓子编著、南齐龚庆宣重新编次厘定《刘涓子鬼遗方》（B错）。《太平圣惠方》简称《圣惠方》，汉医方书类著作，属于中国宋代官修方书。尚药奉御王怀隐会同副使王佑、郑奇并医官陈昭遇等人共同整理编次，宋太宗亲自写序，题名为《太平圣惠方》（D错）。晋代葛洪著《肘后备急方》（E错）。